患者，女，35岁，复杂部分发作性癫痫病史12年，最初使用苯妥英钠单药治疗，6个月前因癫痫控制不佳提高苯妥英钠剂量，因不能耐受不良反应换用卡马西平联合丙戊酸钠治疗，癫痫得到控制。患者近期出现体重增加及严重脱发，到神经内科复诊。患者同时患有2型糖尿病，长期口服二甲双胍、阿卡波糖治疗。此外患者长期服用复合维生素B。患者出现体重增加及严重脱发，可能的原因是
A. 糖尿病病情进展
B. 丙戊酸钠的不良反应
C. 停用了苯妥英钠
D. 卡马西平的不良反应
E. 卡马西平和阿卡波糖的相互作用

正确答案：B。丙戊酸钠的不良反应

解析：本题考查丙戊酸钠。患者出现体重增加及严重脱发，可能的原因是丙戊酸钠的不良反应（B对）。丙戊酸钠的不良反应主要有肝中毒、脱发、体重增加、胃肠道功能紊乱等。糖尿病（A错）主要症状是多饮、多尿、多食、体重减轻。苯妥英钠（C错）的不良反应是共济失调，视物模糊，齿龈增生，镇静作用。卡马西平的不良反应（D错）是共济失调，复视，肝损伤，骨髓抑制，皮疹，低钠血症，白细胞减少，抗惊厥药物过敏综合征。个别情况下，阿卡波糖（E错）可影响地高辛的生物利用度，因此需调整地高辛的剂量。